休克晚期发生
A. 毛细血管前阻力增大
B. 毛细血管后阻力增大
C. 两者均有
D. 两者均无
E. 无

正确答案：D。两者均无

解析：休克晚期即微循环衰竭期，此期微血管发生麻痹性扩张（D对ABCE错），毛细血管大量开放，微循环中可有微血栓形成，血流停止，出现不灌不流状态，组织几乎完全不能进行物质交换，得不到氧气和营养物质供应，甚至可出现毛细血管无复流现象。